下列哪一项指标不是队列研究中所用的指标
A. RR
B. AR
C. OR
D. PAR

正确答案：C。OR

解析：本题考查队列研究的研究指标。队列研究涉及的指标包括相对危险度（RR）（A对）、归因危险度（AR）（B对）和人群归因危险度（PAR）（D对）等。比值比OR（C错，为本题正确答案）为病例对照研究的重要参考指标。